纸色谱固定相为
A. 水
B. 甲醇
C. 乙醇
D. 乙酸乙酯
E. 甲醚

正确答案：A。水

解析：本题考查的是纸色谱的固定相。纸色谱固定相为水（A对）。纸色谱的固定相为色谱纸上吸附的水，移动相一般选择水饱和的有机溶剂。